慢性肾小球肾炎，主要原因为水钠潴留的高血压治疗首选
A. α受体阻滞剂
B. 呋塞米
C. ACE抑制药类
D. 钙拮抗剂
E. β受体阻滞剂

正确答案：B。呋塞米

解析：慢性肾小球肾炎，主要原因为水钠潴留的高血压治疗应首选噻嗪类利尿剂，若噻嗪类无效应改用袢利尿剂，本题答案无噻嗪类利尿剂，那么呋塞米（袢利尿剂）为最佳答案（B对）。α受体阻滞剂（A错）、ACEI抑制药类（C错）、钙拮抗剂（D错）主要通过扩张血管来降低血压，无利尿作用。β受体阻滞剂主要通过抑制心脏收缩，减少心排量来降低血压，无利尿作用（E错）。